哪种充填材料与牙体组织间发生真正的化学粘接
A. 复合树脂
B. 玻璃离子体
C. 复合体
D. 银汞合金
E. 氧化锌粘固剂

正确答案：B。玻璃离子体

解析：玻璃离子体通过酸碱反应固化。聚丙烯酸链的羧基团能与牙体结构中的钙离子发生络合反应，使材料与矿化的牙体组织发生真正的化学粘接。掌握“牙体充填材料之玻璃离子及复合体”知识点。